支原体与病毒的相同点是
A. 个体微小，能通过滤菌器
B. 胞膜中含大量胆固醇
C. 对抗生素敏感
D. 有两种核酸
E. 能在无生命培养基上生长繁殖

正确答案：A。个体微小，能通过滤菌器

解析：病毒是一种体积微小，可以通过滤菌器，结构简单，只含有一种类型的核酸DNA或RNA。必须寄生在活的和敏感的细胞内，以复制的方式进行增殖的非细胞型微生物。支原体科为无细胞壁的原核细胞型微生物，细胞膜含有胆固醇，可通过除菌滤器，二分裂繁殖，是目前所知能在无生命培养基中生长繁殖的最小的原核细胞型微生物。掌握“支原体”知识点。